孕妇不能服用的抗疟药
A. 氯喹
B. 青蒿素
C. 乙胺嘧啶
D. 伯氨喹
E. 奎宁

正确答案：E。奎宁